某医学科研人员将处于试验阶段的药物用于临床并向患者收取费用。该做法主要违背的医学科研伦理要求是
A. 敢于创新
B. 规范操作
C. 精益求精
D. 动机纯正
E. 公私兼顾

正确答案：D。动机纯正

解析：医学科研人员的道德规范：（－）尊重科学，严谨治学（二）动机纯正，勇于创新（三）谦虚谨慎，团结协作。某科研人员将处于试验阶段的药物用于临床并向患者收取费用。违背的医学科研伦理要求是动机纯正（D对）。